关于脂-水分布系数说法错误的是
A. 表示的是内源化合物的脂溶性
B. 是一种物质在脂相和水相分布达到平衡以后，其在脂相和水相溶解度之比
C. 一般来说，外源化合物的脂-水分布系数越大，经膜扩散转运越快
D. 脂溶性外源化学物易于以被动扩散方式通过生物膜

正确答案：A。表示的是内源化合物的脂溶性

解析：本题考查脂-水分布系数。脂-水分布系数是一种物质在脂相和水相分布达到平衡以后，其在脂相和水相溶解度之比（B对）。脂-水分布系数表示的是外源化合物的脂溶性（A错，为本题正确答案）。一般来说，外源化合物的脂-水分布系数越大，经膜扩散转运越快（C对）。脂溶性外源化学物易于以被动扩散方式通过生物膜（D对）。